主要化学成分为有机酸类化合物的中药有
A. 洋金花
B. 金银花
C. 当归
D. 丹参
E. 马兜铃

正确答案：B、C、D、E。金银花；当归；丹参；马兜铃

解析：本题考查的是含有机酸的常用中药。主要化学成分为有机酸类化合物的中药有金银花（B对）、当归（C对）、丹参（D对）与马兜铃（E对）。有机酸是一类含羧基的化合物（不包括氨基酸），广泛分布在植物界中，存在于植物的花、叶、茎、果、根等部位，多数与钾、钠、钙等金属离子或生物碱结合成盐的形式存在，也有结合成酯存在的。含有机酸的中药有金银花、当归、丹参、马兜铃等。洋金花（A错）主要含生物碱类化合物。洋金花主要化学成分为莨菪烷类生物碱，由莨菪醇类和芳香族有机酸结合生成的一元酯类化合物。主要有莨菪碱（阿托品）、山莨菪碱、东莨菪碱、樟柳碱和N-去甲莨菪碱。《中国药典》以东莨菪碱为指标成分进行含量测定，要求东莨菪碱不得少于0.15%。